下列各项，属胃的生理功能的是
A. 主运化水谷
B. 主受纳腐熟
C. 主受盛化物
D. 主泌别清浊
E. 主升清降浊

正确答案：B。主受纳腐熟

解析：胃有将饮食物初步消化，并形成食糜的机能（胃主腐熟水谷），也具有接受和容纳饮食水谷的机能（胃主受纳水谷）（B对），受盛化物、泌别清浊是小肠的生理功能（CD错），运化水谷、升清降浊是脾的生理功能（AE错）。